目前关于转基因食品的管理比较认同的原则是
A. 实质等同
B. 不实质等同
C. 实质不等同
D. 一律同等看待
E. 以上都不正确

正确答案：A。实质等同